否认自己有病，不及时就医是患者角色的
A. 角色行为缺如
B. 角色行为冲突
C. 角色行为减退
D. 角色行为强化
E. 角色行为异常

正确答案：A。角色行为缺如